男，25岁。右侧阴囊坠胀3个月。查体：右侧睾丸增大、质硬，有沉重感。应首先考虑的疾病是
A. 鞘膜积液
B. 睾丸炎
C. 睾丸扭转
D. 睾丸肿瘤
E. 睾丸结核

正确答案：D。睾丸肿瘤

解析：青年男性患者，右侧阴囊坠胀，查体见右侧睾丸增大、质硬、有沉重感（提示可能有睾丸肿瘤），结合患者病史和体查，应首先考虑右侧睾丸肿瘤（D对）。睾丸肿瘤是20～40岁青壮年男性常见的实体肿瘤，而且右侧较左侧更常见。典型的表现是睾丸肿胀或变硬，表面光滑，质硬而沉重，有轻微坠胀或钝痛。鞘膜积液（P581）（A错）表现为阴囊或腹股沟囊性肿块，呈慢性、无痛性逐渐增大，积液量多时可有阴囊下坠、胀痛和牵扯感，体检时睾丸不能触及。睾丸炎（B错）主要表现为高热、畏寒，患侧睾丸疼痛，并向腹股沟放射，睾丸肿大、压痛明显，阴囊皮肤红肿。睾丸扭转（C错）发病急骤，多于睡眠中发病，患者一侧睾丸和阴囊会剧烈疼痛，常伴严重的恶心、呕吐，睾丸触痛明显。睾丸结核（P548）（E错）通常是附睾结核直接扩展蔓延所致，局部表现为睾丸隐痛、下坠感，多与附睾结核同时存在，表现为睾丸肿大、明显的疼痛，查体常可触及串珠样、粗硬的输精管，尿沉渣检查可见抗酸杆菌。